下列关于药物利用研究的叙述错误的是
A. 可以提示病人药物治疗的预后情况
B. 可以提示药物消耗的基本情况
C. 可以了解药物临床的实际消耗
D. 可以了解药物消耗分布与疾病谱的关系
E. 可以预测药品的需求量和需求结构

正确答案：A。可以提示病人药物治疗的预后情况